黄疸伴胆囊肿大者最常见于
A. 胆总管以上梗阻
B. 胆总管以下梗阻
C. 胆囊管梗阻
D. 左右肝管汇合部梗阻
E. 胆囊癌肝门转移

正确答案：B。胆总管以下梗阻

解析：黄疸的患者，若胆道阻塞，阻塞上方的压力升高，胆管扩张，常导致伴胆囊肿大，故黄疸伴胆囊肿大者最常提示胆总管以下有梗阻（B对），常见于胰头癌、壶腹癌、胆总管癌、胆总管结石。胆总管以上梗阻（A错）、胆囊管梗阻（C错）、左右肝管汇合部梗阻（D错）、胆囊癌肝门转移（E错）都没有胆囊肿大。